白细胞计数增高、中性粒细胞增高，临床无明显发热表现，最可能的诊断是
A. 伤寒
B. 霍乱
C. 风湿
D. 细菌性痢疾
E. 结肠炎

正确答案：B。霍乱

解析：临床上霍乱（B对）无明显发热表现，其血常规示：白细胞可达10×l0⁹/L以上，中性粒细胞和单核细胞增多。伤寒（A错）伴有持续高热，发热原因未明，尤以缓慢起病、呈梯形上升并持续1～2周以上者多见，其血常规示：外周血白细胞总数大多为（3～5）×10⁹/L，伴中性粒细胞减少及嗜酸性粒细胞减少或消失。风湿（C错）的白细胞及其分类多在正常范围。细菌性痢疾（D错）伴有发热，其血常规示：白细胞总数轻至中度增高，以中性粒细胞为主，可达（10～20）×10⁹/L。结肠炎（E错）多伴有发热，其血常规示：为白细胞总数增加。